以下是开展生长发育调查的主要目的，除了
A. 研究不同儿童少年群体的生长发育特点和规律
B. 探讨各种内外因素对生长发育的影响，从中发现主要影响因素，提出相应干预措施
C. 制定本地区儿童少年生长发育正常值或评价指标
D. 检验、评价学校保健措施对促进儿童少年生长发育的实际效果
E. 作为衡量学校贯彻《学校卫生工作条例》工作的考核依据

正确答案：E。作为衡量学校贯彻《学校卫生工作条例》工作的考核依据